左腕掌侧切割伤小指和环指尺侧半感觉消失，夹纸试验阳性，可能损伤的神经是
A. 正中经神经
B. 尺神经
C. 桡神经
D. 前臂内侧皮神经
E. 前臂骨间背神经

正确答案：B。尺神经

解析：患者有腕掌侧切割伤史，小指和环指尺侧半感觉消失（提示可能为尺神经损伤）、夹纸试验阳性（提示有骨间肌麻痹），结合患者病史、临床表现及体查，该患者最可能损伤的神经为尺神经（B对）。尺神经浅支在手部支配手掌尺侧及尺侧一个半手指的皮肤感觉；深支在手部支配小鱼际肌、全部骨间肌和3、4蚓状肌及拇收肌，故尺神经在腕部损伤主要表现为骨间肌、蚓状肌、拇收肌麻痹所致环、小指“爪形手”畸形，手指内收外展障碍、Froment征及手部尺侧半和尺侧一个半手指感觉障碍，特别是小指感觉消失。本例患者小指和环指尺侧半感觉消失，夹纸试验阳性（提示有骨间肌麻痹），故应诊断为尺神经损伤。正中神经（P700）（A错）在腕部损伤主要表现为拇对掌功能障碍、“猿手”畸形和手的桡侧半感觉障碍。桡神经（P701）（C错）在腕部损伤伸腕功能基本正常，仅有伸拇、伸指障碍，无手部感觉障碍。前臂内侧皮神经（D错）分前、后两支，前支分布于前臂内侧皮肤，后支分布于前臂内后侧皮肤，损伤后可引起相应支配区的皮肤感觉障碍。前臂骨间背侧神经（P701）（E错）为桡神经深支，其损伤后表现为伸拇伸指障碍，而无手部感觉障碍。